下列属于龋病三级预防的是
A. 窝沟封闭
B. 口腔健康教育
C. 发现早期龋及时充填
D. 不能保留的牙应及时拔除
E. 使用各种氟化物的防龋方法

正确答案：D。不能保留的牙应及时拔除

解析：三级预防：①防止龋病的并发症：对龋病引起的牙髓炎、根尖周炎应进行恰当治疗，防止炎症继续发展。对不能保留的牙应及时拔除。②恢复功能：对牙体缺损及牙列缺失，及时修复，恢复口腔正常功能，保持身体健康。掌握“龋病三级预防”知识点。